关于颈外静脉何种说法对
A. 由颞浅静脉和上颌静脉合成
B. 与颈外动脉伴行
C. 沿胸锁乳突肌深面下行
D. 注人锁骨下静脉或静脉角
E. 无

正确答案：D。注人锁骨下静脉或静脉角

解析：颈外静脉由下颌后静脉、耳后静脉和枕静脉在汇合而成（A错）。沿胸锁乳头肌表面下行（C错）。注入锁骨下静脉或静脉角（D对）。